患者，男，32岁。左下后牙龋洞半年前进行银汞合金充填。现牙体折裂一小块，要求重新充填。检查银汞合金充填，舌侧壁牙体折裂一小块。引起折裂的最可能原因是
A. 食物嵌塞
B. 未去除无基釉
C. 充填材料过度收缩
D. 洞形的点、线角圆钝
E. 鸠尾峡过窄

正确答案：B。未去除无基釉

解析：本题考查龋病治疗出现问题及处理。银汞合金对于窝洞形状的制备要求比较高，而导致牙体折裂的原因有可能是窝洞的制备洞型不当，应力过于集中，或者牙体剩余组织过少，抗力不足，或者在制备的过程中未去除无基釉（B对），导致遇到（牙合）力过大时牙体折裂。